呈不规则的扁圆形，有分枝，表面灰白色或黄白色，以茎痕为中心有数圈同心环节的中药材是
A. 白及
B. 半夏
C. 天冬
D. 银柴胡
E. 麦冬

正确答案：A。白及

解析：本题考查的是白及药材的性状鉴别。呈不规则的扁圆形，有分枝，表面灰白色或黄白色，以茎痕为中心有数圈同心环节是药材白及（A对）。白及：【性状鉴别】药材呈不规则扁圆形，多有爪状分枝。表面灰白色至灰棕色，或黄白色，有数圈同心环节和棕色点状须根痕，上面有突起的茎痕，下面有连接另一块茎的痕迹。质坚硬，不易折断，切面类白色，角质样。气微，味苦，嚼之有黏性。半夏（B错）：【性状鉴别】药材呈类球形，有的稍偏斜。表面白色或浅黄色，顶端有凹陷的茎痕，周围密布麻点状根痕；下面钝圆，较光滑。质坚实，断面洁白，富粉性。气微，味辛辣、麻舌而刺喉。天冬（C错）：【性状鉴别】药材呈长纺锤形，略弯曲。表面黄白色至淡黄棕色，半透明，光滑或具深浅不等的纵皱纹，偶有残存的灰棕色外皮。质硬或柔润，有黏性，断面角质样，中柱黄白色。气微，味甜、微苦。银柴胡（D错）：【性状鉴别】药材呈类圆柱形，偶有分枝。表面浅棕黄色至浅棕色，有扭曲的纵皱纹及支根痕，多具孔穴状或盘状凹陷，习称“砂眼”，从砂眼处折断可见棕色裂隙中有细砂散出。根头部略膨大，有密集的呈疣状突起的芽苞、茎或根茎的残基，习称“珍珠盘”。质硬而脆，易折断，断面不平坦，较疏松，有裂隙，皮部甚薄，木部有黄、白色相间的放射状纹理。气微，味甘。麦冬（E错）：【性状鉴别】药材呈纺锤形，两端略尖。表面黄白色或淡黄色，有细纵皱纹。质柔韧，断面黄白色，半透明，中柱细小。气微香，味甘、微苦。